1岁以内小儿的基础代谢量是
A. 44kcal/（kg·d）
B. 30kcal/（kg·d）
C. 25kcal/（kg·d）
D. 40kcal/（kg·d）
E. 55kcal/（kg·d）

正确答案：E。55kcal/（kg·d）

解析：本题为记忆题，婴儿的基础代谢率（BMR）约为55kcal/（kg·d）（E对）。